胆汁排出障碍时，消化作用减弱的酶是
A. 肠激酶
B. 胰蛋白酶
C. 糜蛋白酶
D. 胰脂肪酶
E. 胰淀粉酶

正确答案：D。胰脂肪酶

解析：胆汁中的胆盐、卵磷脂和胆固醇等均可作为乳化剂，降低脂肪的表面张力，使脂肪乳化成微滴分散在水性的肠液中，因而可增加胰脂肪酶的作用面积，促进脂肪的分解消化。当胆汁排除障碍时，增加胰脂肪酶的作用面积的功能消失，胰脂肪酶的作用减弱（D对）。肠激酶（A错）是激活胰蛋白酶原的特异性酶，可使胰蛋白酶原变为有活性的胰蛋白酶。糜蛋白酶（C错）和胰蛋白酶（B错）的作用都是分解蛋白质，糜蛋白酶还有较强的凝乳作用。胰淀粉酶（E错）的主要作用是分解淀粉。该四项与胆汁的排出关系不大。